法洛四联症最早出现的临床表现是
A. 呼吸困难
B. 活动耐力下降
C. 晕厥
D. 青紫
E. 蹲踞

正确答案：D。青紫

解析：法洛四联症由四种畸形组成：右心流出道梗阻、室间隔缺损、主动脉骑跨、右心室肥厚。由于主动脉起跨于两心室之上，主动脉除接受来自左心室的血液外还直接接受一部分来自右心室的静脉血，输送到全身各部，因而出现青紫；同时，肺动脉的狭窄使肺循环进行气体交换的血流量减少，更加重了青紫的程度，生后3～6个月即可出现（D对）。其他症状如呼吸困难（A错）、活动耐力下降（B错）、晕厥（C错）、蹲踞（E错）多出现于生后6～18个月。